防止毒物继续进入人体，减少肺毛细血管渗出，改善肺通气功能等处理措施，适用于哪种毒物中毒的防治
A. 窒息性气体
B. 刺激性气体
C. 有机溶剂
D. 有机磷农药
E. 苯的氨基硝基化合物

正确答案：B。刺激性气体

解析：本题考查刺激性气体的临床表现。刺激性气体（B对ACDE错）对呼吸系统会产生诸多不利影响。其中，ARDS和中毒性肺水肿最为严重。针对这两种症状的治疗原则主要包括：降低肺毛细血管通透性和保持呼吸道通畅，改善和维持通气功能，改善微循环。